直窦
A. 由矢状窦及岩上窦汇合而成
B. 行于大脑镰游离的下缘中
C. 与大脑大静脉合成下矢状窦
D. 行于大脑镰与小脑幕连接处
E. 无

正确答案：D。行于大脑镰与小脑幕连接处

解析：直窦行于大脑镰与小脑幕连接（D对B错），由大脑大静脉和下矢状窦汇合而成（AC错）。